治疗正疟，应首选
A. 柴胡截疟饮
B. 白虎加桂枝汤
C. 柴胡桂枝干姜汤
D. 加味不换金正气散
E. 何人饮

正确答案：A。柴胡截疟饮

解析：正疟是由于疟邪伏于少阳，与营卫相搏，正邪交争而发，治疗应祛邪截疟，和解表里，代表方为柴胡截疟饮（A对）。白虎加桂枝汤，其功用为清热袪邪，可用于治疗温疟(B错)。柴胡桂枝干姜汤，其功用为和解表里，温阳达邪，与截疟七宝饮合用，可用于治疗寒疟（C错）。加味不换金正气散，其功用为发出风毒，适用于痈疽，寒热往来，或内挟风邪，或内气虚馁（D错）。何人饮，其功用为补气养血，适用于劳疟（E错）。